判定单体化合物纯度的方法是
A. 膜过滤
B. 显色反应
C. HPLC
D. 溶解度测定
E. 液-液萃取

正确答案：C。HPLC